下列属于假膜性炎的疾病是
A. 肠伤寒
B. 肠结核
C. 阿米巴痢疾
D. 急性细菌性痢疾
E. 肠血吸虫病

正确答案：D。急性细菌性痢疾

解析：假膜性炎指发生于黏膜的纤维素性炎，因渗出的纤维素、中性粒细胞和坏死黏膜组织以及病原菌等在黏膜表面形成一层灰白色“假膜”而得名。急性细菌性痢疾（D对）的病变特点为大量纤维素渗出形成假膜，故属于假膜性炎。肠伤寒（A错）为急性增生性炎。肠结核（P350）（B错）和肠血吸虫病（P373）（E错）均为慢性肉芽肿性炎。阿米巴痢疾（P369）（C错）为变质性炎。